寄生虫感染时，浸润的炎症细胞主要是
A. 嗜中性粒细胞
B. 单核细胞
C. 淋巴细胞
D. 嗜酸性粒细胞
E. 浆细胞

正确答案：D。嗜酸性粒细胞

解析：寄生虫感染时，浸润的炎细胞主要是嗜酸性粒细胞（D对）。嗜中性粒细胞（A错）浸润多见于细菌感染时。单核细胞（B错）、淋巴细胞（C错）和浆细胞（E错）浸润主要见于非特异性慢性炎症（P78）。